乌梅与阿司匹林联用，会
A. 影响药物吸收
B. 影响药物分布
C. 影响药物代谢
D. 增加药物排泄
E. 减少药物排泄

正确答案：E。减少药物排泄

解析：本题考查的是中西药联用在药动学上的相互作用。乌梅与阿司匹林联用，会减少药物排泄（E对）。中西药联用在药动学上的相互作用：中西药联用时影响药物的吸收，主要是影响药物的透过生物膜吸收和影响药物在胃肠道的稳定性。1.影响吸收（A错）：（1）影响药物透过生物膜吸收：中药中的某些成分如鞣质、药用炭、生物碱、果胶及金属离子等易与西药结合或吸附，特别是以固体形式口服的西药，可导致某些药物作用下降。（2）影响药物在胃肠道的稳定：药物之间通过直接改变胃肠道的内环境，比如酸碱度、胃肠蠕动和排空速率等，间接引起药物吸收情况改变。2.影响分布（B错）：药物分布是指药物吸收后随血液循环分布到各组织间液和细胞内液的过程，与血浆蛋白结合率、血-脑屏障、胎盘屏障密切相关。某些中西药联用相互作用后，血药浓度有所变化，影响药物与血浆蛋白组织结合。3.影响代谢（C错）：中西成药配伍时会影响药酶的活性，从而影响药物在体内的代谢。（1）酶促反应：中药酒剂、酊剂中含有一定浓度的乙醇，乙醇是常见的酶促剂，它能使肝药酶活性增强。（2）酶抑反应：中西药合用时发生酶抑反应也会影响药物在体内代谢，使药效降低或毒副作用增加。4.影响排泄：肾小管内尿液的酸碱度对药物的解离有明显影响。一些中药及其制剂能酸化或碱化肾小管内尿液，从而影响西药的解离，使其重吸收增加或减少，导致排泄较慢或较快。（1）增加排泄（D错）：碱性药物由于与酸性药物发生相互作用，可大大加快药物排泄速度，导致药效降低，甚至失去治疗作用。（2）减少排泄：含有机酸成分的中药，如乌梅、山茱萸、陈皮、木瓜、川芎、青皮、山楂、女贞子等与磺胺类药物、利福平、阿司匹林等酸性药物合用时，因尿液酸化，可使磺胺类药物的溶解性降低，导致尿中析出结晶，引起结晶尿或血尿，增加磺胺类药物的肾毒性；可使利福平和阿司匹林的排泄减少，加重肾脏的毒副作用。